具有吗啡受体部分激动作用的镇痛药是
A. 纳洛酮
B. 布托啡诺
C. 盐酸布桂嗪
D. 磷酸可待因
E. 苯噻啶

正确答案：B。布托啡诺

解析：本题考查阿片类镇痛药。布托啡诺（B对）是具有吗啡受体部分激动作用的麻醉性镇痛药；纳洛酮（A错）为阿片受体拮抗剂，可作为阿片类的解毒剂；盐酸布桂嗪（C错）为国家特殊管理的麻醉药品；磷酸可待因（D错）多用于中等程度以上的疼痛；苯噻啶（E错）能够拮抗组胺H₁受体，主要治疗偏头痛。